患者，男性，35岁，1小时前从二楼跌下，颏部着地，不省人事数分钟后清醒。检查：神志清楚，呼吸急促，口唇发绀，鼻翼煽动，下唇及下颌2—2间牙龈撕裂，下颌弓变窄，舌体后坠，口底血肿形成。抢救措施首先是
A. 吸氧
B. 清创缝合
C. 气管切开
D. 口对口人工呼吸
E. 骨折复位

正确答案：C。气管切开

解析：呼吸急促，口唇紫绀，鼻翼煽动为窒息表现，口底血肿形成，要先气管切开。掌握“牙槽突骨折、颌骨骨折”知识点。